EB病毒抗体VCA-IgA及EB-DNA检测都可用于鼻咽癌筛查，两种方法的灵敏度分别为70%和65%，为了提高筛查的灵敏度，可采用的联合试验方法是
A. 扩大筛查人群
B. 采用串联试验
C. 采用并联试验
D. 选择筛查高危人群
E. 增加筛查频率

正确答案：C。采用并联试验

解析：本题考查可提高筛查的灵敏度的联合试验方法。联合试验分为串联试验与并联试验。 并联试验（C对ABDE错）即全部筛检试验同时平行开展，任何一项筛检试验结果阳性就可判定为阳性。该方法可以弥补两种方法灵敏度都不足的问题，提高筛查整体的灵敏度，但会降低特异度。